男性，72岁。无牙颌，全口义齿戴用10年。临床检查发现义齿人工牙（牙合）面重度磨耗，口角下垂，口角黏膜糜烂。该患者还可能存在的临床表现是
A. 颏唇沟变浅
B. 鼻唇沟变深
C. 面部表情僵硬
D. 说话时义齿撞击音
E. 息止（牙合）间隙2mm

正确答案：B。鼻唇沟变深

解析：本题考查全口义齿戴用后可能出现的问题。患者男性，72岁。无牙颌，全口义齿戴用10年（义齿时间长）。临床检查发现义齿人工牙（牙合）面重度磨耗（垂直距离低），口角下垂，口角黏膜糜烂（口角炎）。该患者还可能存在的临床表现是鼻唇沟变深（B对）。当义齿垂直距离恢复得过低时会有以下：表现为面部下1/3的距离减小，唇红部显窄，口角下垂，颏唇沟变深，颏部前突。用垂直距离过小的（牙合）托制成的全口义齿戴入口中，看上去患者像没戴义齿似的，息止（牙合）间隙偏大，咀嚼肌的紧张度减低，咀嚼无力，咀嚼效能较低。颏唇沟变浅（A错）、面部表情僵硬（C错）、说话时义齿撞击音（D错）、息止（牙合）间隙2mm（E错）都是垂直距离过高的表现，不符合题意。